药品所含成分的名称与国家药品标准或者省、自治区、直辖市药品标准规定不符合的是
A. 劣药
B. 假药
C. 保健药品
D. 非处方药
E. 特殊药品

正确答案：B。假药

解析：药品所含成分的名称与国家药品标准或者省、自治区、直辖市药品标准规定不符合的是假药（B对）。劣药是指药品成分含量不符合国家药品标准规定的药品（A错）。保健药品即以调节人体机能为主要目的的保健品（C错）。非处方药是指为方便公众用药，在保证用药安全的前提下，经国家卫生行政部门规定或审定后，不需要医师或其它医疗专业人员开写处方即可购买的药品（D错）。特殊药品是指国家制定法律制度，实行比其他药品更加严格的管制的药品（E错）。